选择性毒性不可发生在
A. 物种之间
B. 个体间
C. 群体间
D. 细胞间

正确答案：D。细胞间

解析：本题考查选择性毒性的相关内容。选择性毒性一般是指化学物在不同物种间的毒性差异。目前认为，化学物的这种毒性差异即选择性毒性可发生在物种之间（A对），也可发生在同种属群体中（C对）个体之间或同一个体内（B对）不同器官或系统间。选择性毒性不可发生在细胞间（D错，为本题正确答案）。